严重的环境污染引起的区域性疾病被称为
A. 公害病
B. 职业病
C. 地方病
D. 疫源性疾病
E. 以上都不是

正确答案：A。公害病

解析：本题考查公害病。公害病（A对BCDE错）是指由人类活动造成严重环境污染引起公害所发生的地区性疾病。如与大气污染有关的慢性呼吸道疾病、由含汞废水引起的水俣病、由含镉废水引起的痛痛病等。